关于胸膜腔负压生理意义的叙述，错误的是
A. 保持肺的扩张状态
B. 有利于静脉回流
C. 维持正常肺通气
D. 使中心静脉压升高
E. 胸膜腔负压消失可导致肺塌陷

正确答案：D。使中心静脉压升高